由抗血小板表面成分抗体引起
A. 自身免疫性血小板减少性紫癜
B. 自身免疫性中性粒细胞减少症
C. 重症肌无力
D. 肺出血肾炎综合征
E. 恶性贫血

正确答案：A。自身免疫性血小板减少性紫癜

解析：自身免疫性血小板减少性紫癜是由抗血小板表面成分抗体引起的血小板减少性疾病，患者可发生凝血障碍。掌握“常见口腔自身免疫性疾病及自身免疫性疾病的治疗”知识点。